非处方药来源于
A. 处方药
B. 临床长期使用，由医药专家评审遴选
C. 经卫生行政部门审批颁布
D. 国家基本药物目录
E. 民间传统用药

正确答案：A、B、C。处方药；临床长期使用，由医药专家评审遴选；经卫生行政部门审批颁布

解析：本题考查非处方药的来源。非处方药来源于：处方药（A对）、临床长期使用，由医药专家评审遴选（B对）、经卫生行政部门审批颁布（C对）。非处方药是指由国家药品监督管理局公布的，不需要凭执业医师和执业助理医师处方，消费者可以自行判断、购买和使用的药品。总体来说，非处方药是经过临床较长时间验证、疗效肯定、服用方便、被实践证明消费者可以在药师指导下自主选择的药品，其来源于处方药，并必须按非处方药标签和说明书所示内容合理使用。